对于外科创口，在引流时的适应证说法正确的是
A. 无论是感染创口还是无菌创口均不需要放置引流
B. 部位深在的手术术后应该无渗液等，因此无需引流
C. 凡是留有无效腔的创口，必须放置引流
D. 止血不彻底的创口只需关闭创口即可
E. 凝血功能低下的患者只需创口止血即可，不必引流

正确答案：C。凡是留有无效腔的创口，必须放置引流

解析：①感染创口如脓肿切开等必须放置引流物，以使腔内脓液得以不断排出；切口有严重感染或手术本身属于污染创口，为防止感染，也应考虑放置引流；无菌创口，特别是单纯整复手术，一般不放置引流。②对范围广泛的大手术及部位深在的中等手术，考虑其术后仍有部分渗血、渗液，应放置引流。③凡术中因组织缺损较大、未能完全消灭无效腔的口内、口外创口，必须放置引流。其引流物需放置于无效腔底部，才能保证彻底引流。④对术中止血不彻底和凝血功能低下的患者，为防止血肿形成，也应放置引流。掌握“口外手术打结、缝合及外科引流”知识点。